男，30岁，约一年时间孤僻寡言，近期由于被上级批评后出现失眠，不上班并紧闭门窗，声称有人监视自己，在家中不敢谈话，说家中已被安装窃听器，公安局也要逮捕自己，不吃妻子做的饭食，认为妻子已同他人合伙在饭菜中放了毒药。因此殴打妻子。除药物治疗外要注意的是
A. 说服病人放弃怀疑
B. 外出旅行、疗养
C. 防止发生意外
D. 更换工作单位
E. 请上级、同事改变对病人的态度

正确答案：C。防止发生意外

解析：该病例患者为青年男性，起病较缓慢，从有人监视自己到妻子与同伙人下毒（对象渐趋泛化，内容日益荒诞的妄想）为主要表现，故诊断为精神分裂症偏执型。精神分裂症患者在病态情况下最可能出现不听劝阻，一意孤行，出现意外（C对），如怕有人投毒，冲动伤人等行为异常表现。